患者诸肢节疼痛，身体魁羸，脚肿如脱，头眩短气，温温欲吐，每逢阴雨天加重，舌质红，苔薄白，脉弦，应选用
A. 乌头赤石脂丸
B. 桂枝芍药知母汤
C. 桂枝附子汤
D. 白术附子汤
E. 甘草附子汤

正确答案：B。桂枝芍药知母汤

解析：患者诸肢节疼痛，身体魁羸，脚肿如脱，头眩短气，温温欲吐，诊为风湿历节之病。关节疼痛是因风湿流注于筋脉关节，气血通行不畅所致。身体逐渐消瘦，痛久不解、正气日衰，邪气日盛，湿无出路、渐次化热伤阴，流注下肢，则两脚肿胀且麻木不仁。风与湿邪上犯、清阳不升，则头眩；湿阻中焦，气机不利则短气，胃失和降则呕恶。治以桂枝芍药知母汤祛风除湿，温经散寒，佐以滋阴清热（B对）。方中桂枝与附子通阳宣痹，温经散寒；桂枝配麻黄、防风，祛风而温散表湿；白术、附子助阳除湿；知母、芍药益阴清热；甘草和胃调中。诸药相伍，表里兼顾，且有温散而不伤阴、养阴而不碍阳之妙。